治疗产褥中暑暑伤津气证，应首选
A. 白虎汤
B. 竹叶石膏汤
C. 清暑益气汤
D. 凉膈散
E. 银翘散

正确答案：C。清暑益气汤

解析：产褥中暑暑伤津气证，治宜清热解暑，益气生津，方选清暑益气汤（C对）。白虎汤（A错）清暑泻热，透邪外达，治疗产后暑入阳明证。竹叶石膏汤（B错）清气分热，清热生津，益气和胃，用于中暑后余热未清、气津两伤证。凉膈散（D错）清热解毒，泻火解毒，具有清上泻下功效，主治上中焦邪郁生热证。银翘散（E错）辛凉透表，清热解毒，用于风热表证。